下列哪种情况尿中胆素原族排泄量减少
A. 肝功能轻度损伤
B. 肠道阻塞
C. 溶血
D. 碱中毒
E. 胆道阻塞

正确答案：E。胆道阻塞